《中国药典》一部规定，要做浸出物测定的中药材有
A. 蛤蚧
B. 金钱白花蛇
C. 蕲蛇
D. 乌梢蛇
E. 全蝎

正确答案：B、C、D、E。金钱白花蛇；蕲蛇；乌梢蛇；全蝎